未经患者或者患者家属同意，对患者进行实验性治疗的，由卫生行政部门给予的处理是
A. 暂停职业活动三个月至六个月
B. 暂停职业活动六个月至一年
C. 给予行政处分
D. 吊销医师职业证书
E. 追究刑事责任

正确答案：B。暂停职业活动六个月至一年

解析：《执业医师法》规定，医师在执业活动中，未经患者或其家属同意，对患者进行实验性临床医疗的，由县级以上人民政府卫生行政部门给予警告或者责令暂停执业活动六个月至一年（B对A错）；情节严重的，吊销医师执业证书（D错）；构成犯罪的，依法追究刑事责任（E错），而题中未说明情节严重或者构成犯罪。